某研究者釆用随机单盲临床试验比较两种降压药（波依定与洛汀新）对轻、中度原发性高血压患者的降压疗效。其单盲设计中不了解试验分组情况的人是
A. 测量血压的护士
B. 实施治疗的医生
C. 负责设计的研究者
D. 统计分析人员
E. 接受治疗的患者

正确答案：E。接受治疗的患者

解析：该临床试验采用的是单盲设计，单盲设计中不了解分组和干预措施的是研究对象自己，即接受治疗的患者（E对）。如果是研究对象和观察者均不知道分组情况和接受治疗措施的具体内容则为双盲设计，临床试验中的观察者可以是护士或者医生（AB错）。研究对象、观察者和资料分析者均不知患者的分组情况和接受治疗措施的具体内容称为三盲（D错）。临床试验中负责设计的研究者是负责设计试验的，不可能不清楚分组和干预措施（C错）。